前列腺癌筛查最常用的方法
A. X线片
B. CT
C. 前列腺特异性抗原检测
D. 前列腺穿刺
E. 直肠直检

正确答案：C。前列腺特异性抗原检测